影响宗气盛衰的脏腑是
A. 心与肺
B. 肝与肾
C. 肺与肾
D. 肺与脾
E. 肝与脾

正确答案：D。肺与脾

解析：宗气的生成有两个来源：一是脾胃运化的水谷之精所化生的水谷精气，一是肺从自然界中吸入的清气，两者结合生成宗气（D对）。